外邪引起的疮疡，最常见的病因是
A. 外感毒邪
B. 风湿，风热
C. 火毒，热毒
D. 气郁，火郁
E. 大肠杆菌感染

正确答案：C。火毒，热毒

解析：广义的疮疡是指一切体表外科疾病的总称，外科疾病的发生以“热毒”“火毒”最为常见，正如《医宗金鉴·外科心法要诀》所说：“痈疽原是火毒生”（C对）。